1605、乐果中毒时洗胃禁用
A. 肥皂水
B. 1%～5%碳酸氢钠溶液
C. 1%～2%氯化钠溶液
D. 1：2000～5000高锰酸钾溶液
E. 微温的清水

正确答案：D。1：2000～5000高锰酸钾溶液

解析：本题考查中毒解救。1605、乐果中毒时洗胃禁用1：2000～5000高锰酸钾溶液（D对）。因为高锰酸钾是强氧化剂，可促使其转化为对氧磷而增加其毒性。